石斛的功效是
A. 益胃生津，清肺降火
B. 益胃生津，清心除烦
C. 益胃生津，润肺养阴
D. 益胃生津，养阴安神
E. 益胃生津，滋阴清热

正确答案：E。益胃生津，滋阴清热

解析：石斛的功效是益胃生津，滋阴清热（E对），可用于治疗胃阴虚证，热病伤阴证。